医疗废物指
A. 医疗卫生机构在医疗、预防、保健活动中产生的危害性废物
B. 医疗卫生机构在医疗、预防、保健以及其他相关活动中产生的具有直接或者间接感染性、毒性以及其他危害性的废物
C. 医疗卫生机构在医疗、预防、保健活动中产生的具有直接或者间接感染性、毒性以及其他危害性的废物
D. 在日常公益活动中产生的废物
E. 医疗卫生机构在医疗、预防、保健活动中产生的具有直接感染性的废物

正确答案：B。医疗卫生机构在医疗、预防、保健以及其他相关活动中产生的具有直接或者间接感染性、毒性以及其他危害性的废物